女性，27岁。右上中切牙金合金烤瓷冠修复2个月，牙龈出血、胀痛不适。唇侧龈缘红肿，探诊出血，唇侧颈缘位于龈沟内1.5mm。引起牙龈胀痛最可能的原因是
A. 冠边缘过深
B. 食物刺激牙龈
C. 口腔卫生状况差
D. 戴冠时损伤了牙龈
E. 粘固剂残留在龈沟内

正确答案：A。冠边缘过深

解析：本题考查修复体戴入后的问题及处理。金属烤瓷冠唇侧龈边缘应位于龈缘下较浅的位置（龈缘下0.5mm），以利于美观。但如果冠边缘位于龈沟内过深（A对）的位置，容易在肩台预备时损伤牙龈，印模不准确，导致修复体边缘不密合，产生牙龈炎。该病例的冠边缘位于龈下1.5mm，显然过深，是牙龈炎最可能的原因。食物刺激牙龈（B错）、口腔卫生状况差（C错）不可能只影响两个全冠修复的患牙牙龈。如果是戴冠时损伤牙龈，经过2个月后应早已恢复正常，所以原因不可能是戴冠时损伤了牙龈（D错）。粘固剂残留导致的牙龈炎只会出现在有粘固剂残留的局部（E错），而不会导致2个患牙唇侧的炎症。